某女，70岁，平素倦怠乏力，舌干口燥，入秋以来又见劳嗽咯血，宜选用的药是
A. 南沙参
B. 鳖甲
C. 北沙参
D. 百合
E. 麦冬

正确答案：A。南沙参

解析：本题考查的是南沙参的主治病证。平素倦怠乏力，舌干口燥，入秋以来又见劳嗽咯血，宜选用的药是南沙参（A对）。南沙参：【主治病证】（1）肺热燥咳有痰，阴虚劳嗽咯血。（2）气阴两伤之舌干口渴。鳖甲（B错）：【主治病证】（1）阴虚阳亢之头晕目眩，热病伤阴之虚风内动。（2）阴虚发热。（3）久疟疟母，癥瘕。北沙参（C错）：【主治病证】（1）肺热燥咳，阴虚劳嗽咯血。（2）阴伤津亏之舌干口渴。百合（D错）：【主治病证】（1）肺虚久咳，阴虚燥咳，劳嗽咯血。（2）虚烦惊悸，失眠多梦，精神恍惚。麦冬（E错）：【主治病证】（1）肺热燥咳痰黏，阴虚劳嗽咯血。（2）津伤口渴，内热消渴。（3）心阴虚、心火旺之心烦失眠。（4）肠燥便秘。